血管扩张剂治疗心力衰竭的主要作用机制是
A. 增强心肌收缩力
B. 改善心肌供血
C. 降低心脏前、后负荷
D. 降低心肌耗氧量
E. 减慢心率

正确答案：C。降低心脏前、后负荷

解析：血管扩张剂主要用于治疗急性心衰，包括硝普钠、硝酸酯类、α受体拮抗剂等，其作用均为扩张动脉和（或）静脉，降低外周阻力，以降低心脏前、后负荷（C对）。增强心肌收缩力（A错）是正性肌力药物的主要作用，如洋地黄类药物、β受体兴奋剂等。血管扩张剂如硝酸酯类药物（P241）可扩张正常和粥样硬化的冠状动脉，改善心肌缺血（B错），此为治疗急性冠脉综合征的主要作用机制。心肌耗氧的多少主要由心肌张力、心肌收缩强度和心率所决定的，故常用心率与收缩压的乘积作为估计心肌耗氧量的指标。β受体阻滞剂（美托洛尔、比索洛尔等）治疗慢性心力衰竭的机制是通过减慢心率（E错），降低心肌耗氧量（D错），增加心脏的工作效率，阻断过度激活的肾素-血管紧张素-醛固酮系统，减轻心脏容量负荷和工作负荷。